调节可摘局部义齿固位力的措施如下，除外
A. 调整义齿就位道
B. 调控基牙间的分散度
C. 增减直接固位体的数目
D. 需增加横向固位力者选用铸造卡环
E. 调节卡环臂进入倒凹区的深度和坡度

正确答案：D。需增加横向固位力者选用铸造卡环

解析：本题考查调节固位力的具体措施。与弯制卡环相比，铸造卡环与基牙更密合，更利于增加稳定性，而不是增加横向固位力（D错，为本题的正确答案）；通过卡环的弹性卡抱作用实现横向固位力。可摘局部义齿固位力可以通过调整义齿就位道（A对）、调整基牙间的分散度（B对）、增减直接固位体的数目（C对）、调节卡环臂进入倒凹区的深度和部位（E对）、选择和修整基牙的固位形、选择刚度及弹性限度较大的固位体材料、选用不同制作方法的卡环、利用制锁作用来增强固位效果、充分利用吸附力、表面张力和大气压力来协同固位等措施进行调节。